导致乳酸酸中毒的原因中例外的是
A. 心搏骤停
B. 休克
C. 低氧血症
D. 严重肝疾患
E. 长期使用噻嗪类利尿剂

正确答案：E。长期使用噻嗪类利尿剂

解析：长期使用噻嗪类利尿剂（E错，为本题正确答案）时，抑制了肾髓袢升支对Cl-的主动重吸收，导致H+经肾大量丢失使HC03-大量被重吸收，引起代谢性碱中毒。心搏骤停（A对）、休克（B对）、低氧血症（C对）都可以使细胞内糖的无氧酵解增强而引起乳酸增加，产生乳酸性酸中毒，严重肝疾患（D对）由于乳酸利用障碍也可引起血浆乳酸过高。